只有一个开口的病理性盲管称为
A. 窦道
B. 糜烂
C. 溃疡
D. 瘘管
E. 空洞

正确答案：A。窦道

解析：组织坏死后，只有一个开口（只开口于皮肤黏膜表面）的病理性盲管称为窦道（A对）。糜烂（B错）是指皮肤、黏膜浅表的组织缺损。溃疡（C错）是指皮肤、黏膜较深的组织缺损。瘘管（D错）是指连接两个内脏器官或从内脏器官通向体表的通道样缺损。空洞（E错）是指坏死物液化后，经自然管道排出体外后所残留的空腔。